糖尿病性昏迷.宜选用
A. 普通胰岛素
B. 甲磺丁脲
C. 氯磺丙脲
D. 苯乙双胍
E. 二甲双胍

正确答案：A。普通胰岛素

解析：糖尿病昏迷是由糖尿病引起的一组以意识障碍为特征的临床综合征，包括糖尿病酮症酸中毒和高渗高血糖综合征，是糖尿病最危险、最常见的合并症。早期酮症患者仅需给与胰岛素和足量补液并严密观察，酸中毒患者应尽快恢复血容量、降低血糖、纠正电解质紊乱状态、积极治疗原发病等。高渗高糖综合征治疗原则与糖尿病酮症酸中毒一致（A对）。二甲双胍（E错）和苯乙双胍（D错）属于双胍类降糖药，禁忌用于T2DM合并严重急性严重代谢功能紊乱。甲磺丁脲（B错）和氯磺丙脲（C错）属于磺酰脲类降糖药，用于胰岛功能尚存的2型糖尿病且单用饮食控制无效者。